慢性根尖周炎类型中，哪一种类型是以局部骨质增生为特征的
A. 根尖周肉芽肿
B. 根尖周囊肿
C. 根尖周骨硬化症
D. 根尖周脓肿
E. 以上均不是

正确答案：C。根尖周骨硬化症

解析：慢性根尖周炎的病变类型有四种：根尖周肉芽肿、慢性根尖周脓肿、根尖周囊肿和根尖周致密性骨炎；前三种以骨破坏病损为特征，后一种则为局部骨质增生性病变。掌握“慢性根尖周炎”知识点。